颌面部检查的内容不包括
A. 面部皮肤颜色、营养状态
B. 颌面部外形的对称性
C. 咀嚼肌检查
D. 侧面轮廓的面型
E. 颌面各部分之间的比例关系

正确答案：C。咀嚼肌检查

解析：本题考查修复学临床检查。颌面部检查的内容不包括咀嚼肌检查（C错，为本题正确答案）。咀嚼肌检查是包括在“颞下颌关节区”的检查范围之内的。口腔颌面部检查的内容是通过视诊，仔细观察患者颌面部的外形及其他特征，主要包括面部皮肤颜色、营养状态（A对）；颌面部外形是否正常，有无缺损；颌面部个部分之间比例关系是否协调对称（B对），有无颌面部畸形；口唇的外形，唇部松弛程度，笑线的高低，上下前牙位置与口唇的关系；侧面轮廓是直面形、凸面形还是凹面形（D对），颅、面、颌、牙各部分的前后位置和大小比例是否正常（E对），有无颌骨前突或者后缩等异常情况。